流行性感冒的传播途径主要是
A. 空气传播
B. 接触传播
C. 垂直传播
D. 食物传播
E. 医源性传播

正确答案：A。空气传播